在神经-骨骼肌接头处，消除乙酰胆碱的酶是
A. 腺苷酸环化酶
B. ATP酶
C. 胆碱酯酶
D. 单胺氧化酶
E. Na+-K+-ATP酶

正确答案：C。胆碱酯酶